男性，36岁。患者呕血不止、烦躁出冷汗。曾有胃溃疡史，呕血的原因可能为
A. 胃溃疡
B. 十二指肠球溃疡
C. 慢性胃炎
D. 胃癌
E. 十二指肠球炎

正确答案：A。胃溃疡

解析：患者中年男性，有胃溃疡病史，呕血不止、烦躁出冷汗（休克症状），提示出血量大，考虑该患者呕血的原因为胃溃疡（A对）。十二指肠球溃疡（B错）位于幽门以下，少发大量呕血。慢性胃炎（C错）患者大多无明显症状，可表现为中上腹不适、饱胀、钝痛、烧灼痛等，体征多不明显，消化道症状少。胃癌（D错）多发生于老年患者，出血通常为慢性、持续性。十二指肠球炎（E错）与十二指肠溃疡症状相似，多表现为中上腹的疼痛，伴有嗳酸、嗳气，无呕血。